男性，15岁。高度水肿，尿蛋白（+++），管型少许，血清蛋白15g/L，血胆固醇10mmol/L，应用泼尼松4周，尿量增加，水肿消退，尿蛋白（+++），此时应用哪项措施
A. 泼尼松原量继续治疗
B. 泼尼松开始减量
C. 加用清蛋白，泼尼松开始减量
D. 加用ACTH，泼尼松减量
E. 加用消炎痛，泼尼松减量

正确答案：A。泼尼松原量继续治疗

解析：青少年男性患者，临床表现为大量蛋白尿（尿蛋白（+++））、低蛋白血症（血清蛋白15g/L）、高度水肿、高血脂（胆固醇10mmol/L，正常值＜5.2mmol/L），符合肾病综合征诊断标准，诊断为肾病综合征。该患者正确泼尼松治疗4周后，出现水肿消退、尿量增加，证明泼尼松治疗有效，为激素敏感型（用药8-12周内肾病综合征缓解），下一步治疗只需继续维持泼尼松原剂量继续治疗（A对BCDE错）至8周后，再做剂量调整。清蛋白可提高胶体渗透压，增加有效循环血量，减轻水肿，增加尿量，可加用，但无需调整激素用量（C错）。ACTH（促肾上腺皮质激素）可以促进糖皮质激素的释放，加用ACTH，泼尼松减量（D错）即类似于维持原剂量的糖皮质激素量，但糖皮质激素更便宜易得，故此举没有意义。消炎痛即吲哚美辛，属于非甾体类抗炎药，对肾病综合征的治疗无效，常用于急、慢性风湿性关节炎等。